某女，67岁，大便秘结，面色无华，头晕目眩，口干，舌淡苔少，脉细涩，辩证为津亏肠燥，治宜选用的中成药是
A. 清宁丸
B. 加味保和丸
C. 槟榔四消丸
D. 麻仁滋脾丸
E. 九制大黄丸

正确答案：D。麻仁滋脾丸

解析：本题考查的是便秘之热秘的辨证论治。患者为便秘之热秘，治宜选用的中成药是麻仁滋脾丸（D错）。便秘之热秘【症状】大便干结，腹胀腹痛，口干口臭，面红心烦，或有身热，小便短赤。舌红，苔黄燥，脉滑数。【中成药应用】常用中成药麻仁胶囊、麻仁润肠丸、麻仁滋脾丸。清宁丸（A错）与九制大黄丸（E错）为妊娠禁用、忌用中成药。胃痛之饮食伤胃证【症状】胃脘疼痛，胀满拒按，嗳腐恶食，或吐不消化食物，吐后或矢气后痛减，大便不爽。舌淡红，苔厚腻，脉滑。【中成药应用】常用中成药开胸顺气丸、沉香化滞丸、加味保和丸（B错）。便秘之气秘【症状】大便干结，或不甚干结，欲便不得出，或便出不爽，胸胁痞满，肠鸣矢气，腹中胀痛，嗳气频作，纳食减少。舌苔薄腻，脉弦。【中成药应用】常用中成药槟榔四消丸（C错）（大蜜丸）、四磨汤口服液、厚朴排气合剂。